临床上看到的融合牙多是
A. 冠部融合
B. 根部融合
C. 冠根完全融合
D. 牙本质融合
E. 牙髓融合

正确答案：A。冠部融合

解析：融合牙根据临床上融合的时间早晚，可以形成冠根完全融合，也可以形成冠部融合而根部分离，或冠部分离而根部融合，临床上多数看到的是冠部融合。掌握“迟萌、多生牙和融合牙”知识点。